颅中窝蝶鞍两侧，由前向后外方，依次排列着
A. 卵圆孔、圆孔和棘孔
B. 圆孔、卵圆孔和棘孔
C. 圆孔、棘孔和卵圆孔
D. 卵圆孔、棘孔和圆孔
E. 棘孔

正确答案：B。圆孔、卵圆孔和棘孔

解析：颅中窝蝶鞍两侧，由前内向后外，依次可见圆孔、卵圆孔和棘孔（B对）。